女方原因实施体外受精-胚胎移植技术，可能产生伦理问题不包括
A. 辅助生殖所生的孩子的父母如何定位
B. 代孕技术是否允许
C. 精子、卵子、胚胎是否商品化
D. 对胎儿进行非医学目的的性别鉴定
E. 婴儿与亲代关系模糊

正确答案：D。对胎儿进行非医学目的的性别鉴定

解析：《人类辅助生殖技术管理办法》第十七条规定，实施人类辅助生殖技术的医疗机构不得对胎儿进行非医学目的的性别鉴定（D错，为本题正确答案）。女方原因实施体外受精-胚胎移植技术，可能产生伦理问题包括：①精子卵子胚胎的道德地位，是具有独立道德地位的个体？是提供者的物质、身体部分？还是属于提供者的财产？②代孕技术是否允许（B对）？③提供者、代孕妇女可否因此获得报酬？精子、卵子、胚胎是否商品化（C对）？④家庭人伦关系的确定，辅助生殖所生的孩子的父母如何定位（A对）？婴儿与亲代关系模糊（E对）等。